表示药物能渗湿利水的味是
A. 辛味
B. 淡味
C. 酸味
D. 涩味
E. 甘味

正确答案：B。淡味

解析：本题考查五味的所示效用及临床应用。表示药物能渗湿利水的味是淡味（B对）。淡味：能渗、能利，有渗湿利水作用，如治水肿、小便不利的猪苓、茯苓，均具淡味。常将淡附于甘。淡味药过用，亦能伤津液，阴虚津亏者慎用。辛味（A错）：能散、能行，有发散、行气、活血作用。如治表证的荆芥、薄荷，治气滞的香附，治血瘀的川芎等，都具有辛味。辛味药大多能耗气伤阴，气虚阴亏者慎用。酸味（C错）：能收、能涩，有收敛固涩作用。如治自汗盗汗、遗精滑精的五味子，治久泻久痢的五倍子，治久咳的乌梅，治大汗虚脱、崩漏经多的山茱萸等，均具酸味。另外，酸能生津、安蛔，如木瓜、乌梅等。酸味药大多能收敛邪气，凡邪未尽之证均当慎用。涩味（D错）：能收、能敛，同酸味一样有收敛固涩作用，如治滑脱诸证的龙骨，治久痢脱肛的赤石脂，治崩漏带下的乌贼骨等，均具涩味。习惯将涩附于酸。涩味药大多能敛邪，邪气未尽者慎用。甘味（E错）：能补、能缓、能和，有补虚、和中、缓急、调和药性等作用。如治虚证的黄芪、熟地、核桃仁、枸杞子，治挛急作痛、调和药性的饴糖、甘草等，均具甘味。某些甘味药还能解药、食毒，如甘草、蜂蜜等。此外，甘味药多质润而善于滋燥。甘味药大多能腻膈碍胃，令人中满，凡湿阻、食积、中满气滞者慎用。